下列甲状腺疾病通常需要手术治疗的是
A. 甲状腺高功能腺瘤
B. 青少年甲状腺功能亢进症
C. 亚急性甲状腺炎
D. 甲状腺功能减退症
E. 甲状腺1cm囊性肿物

正确答案：A。甲状腺高功能腺瘤

解析：甲状腺高功能腺瘤是指甲状腺内有单个或多个自主性高功能结节而引起甲状腺功能亢进症的一种疾病，结节部分功能增高，且有自主性，不受垂体调节，而结节外的甲状腺组织仍受到正常的反馈抑制而呈萎缩改变，手术切除甲状腺高功能腺瘤（A对）能迅速解除对TSH的抑制从而解除对周围组织的抑制作用，使甲状腺恢复正常功能。甲亢手术治疗后患者可能会出现不同程度的甲状腺功能减退，且这种甲减不可逆，影响青少年身体和智力发育，故青少年甲状腺功能亢进症（B错）不宜手术治疗。甲状腺功能减退症（D错）是由各种原因导致的低甲状腺激素血症或甲状腺激素抵抗而引起的全身性低代谢综合征，其治疗目标是将血清TSH和甲状腺激素水平恢复到正常范围，应用左甲状腺素行替代治疗，常需终身用药（九版内科学P690）。亚急性甲状腺炎（C错）是一种与病毒感染有关的自限性甲状腺炎，预后良好，轻型病人仅需应用非甾体抗炎药，中、重型可给予泼尼松（九版内科学P693）。甲状腺1cm囊性肿物（E错）无压迫症状，可不予以处理。